引起牙松动、疼痛
A. 肿瘤发生自上颌窦下壁
B. 肿瘤发生自上颌窦内壁
C. 肿瘤发生自上颌窦后壁
D. 肿瘤发生自上颌窦上壁
E. 肿瘤发生自上颌窦外壁上颌窦癌根据肿瘤发生的部位，临床上可出现不同的症状

正确答案：A。肿瘤发生自上颌窦下壁

解析：当肿瘤发生自上颌窦下壁时，则先引起牙松动、疼痛、龈颊沟肿胀，如将牙痛误诊为牙周炎等而将牙拔除时，则创口不能愈合，形成溃疡，肿瘤突出于牙槽部。掌握“中央性颌骨癌及上颌窦癌”知识点。